常见的手用不锈钢根管切削器械为
A. Protaper
B. R型锉
C. K型锉
D. 机用根管锉
E. 根管冲洗针

正确答案：C。K型锉

解析：手用不锈钢根管切削器械器械：主要是K型和H型器械以及它们的改良产品。掌握“髓腔进入与初预备”知识点。